缝匠肌的作用
A. 屈髋伸膝
B. 屈髋屈膝
C. 屈股二头肌
D. 屈肩关节
E. 无

正确答案：B。屈髋屈膝

解析：缝匠肌的作用是屈髋屈膝（B对），并使已屈的膝关节旋内。